患者，女，24岁。因吃海鲜引发周身风团，瘙痒较甚，迅速消退，不留痕迹，以后又不断成批发生，时隐时现，皮疹色赤，遇热加剧，舌苔薄黄，脉浮数。内治应首选
A. 麻黄桂枝各半汤
B. 桂枝汤
C. 消风散
D. 防风通圣散
E. 玉屏风散

正确答案：C。消风散

解析：瘾疹是一种过敏性皮肤病，表现为形态不一、大小不等的红色或白色风团，境界清楚，一般迅速消退，不留痕迹，以后不断成批出现，时隐时现。患者因进食海鲜后出现瘾疹，其皮疹色赤，遇热加剧，舌红苔黄，脉浮数，治宜消风散，消风散尤善于治疗瘾疹、湿疹、疥疮风湿夹热证（C对）。麻黄桂枝各半汤适用于风寒束表证的瘾疹（A错）。桂枝汤善于治疗风寒表虚证，症见头痛发热、汗出恶风，苔白，脉浮缓等（B错）。防风通圣散功能解表通里，适用于胃肠湿热证的瘾疹（D错）。玉屏风散适用于表虚自汗证，症见汗出恶风、面色㿠白，舌淡苔白，脉浮虚等（E错）。